病毒性脑炎脑脊液的特点是
A. 白细胞数（50-200）×10⁶/L，糖量减少，氯化物下降，蛋白量增多
B. 白细胞数＜10×10⁶/L，糖量正常，氯化物正常，蛋白量降低
C. 白细胞数＜10×10⁶/L，糖量正常，氯化物降低，蛋白量增多
D. 白细胞数（50～200）×10⁶/L，糖量正常，氯化物正常，蛋白量增多
E. 白细胞数＞1000x10⁶/L，糖量减少，氯化物稍降低，蛋白量降低

正确答案：D。白细胞数（50～200）×10⁶/L，糖量正常，氯化物正常，蛋白量增多

解析：病毒性脑膜炎是一组由各种病毒感染引起的脑膜急性炎症性疾病，临床以发热、头痛和脑膜刺激征为主要表现，本病大多呈良性过程（P237）。脑脊液的特点为压力正常或增高，白细胞数正常或增高，可达（10-1000）×10⁶/L，糖量正常，氯化物正常，蛋白量轻度增多（D对）。细菌性脑膜炎时，白细胞数明显增加，蛋白质升高，糖含量下降，氯化物降低。